非甾体抗炎药中镇痛作用较强，对胃肠刺激性最低的是
A. 布洛芬
B. 对乙酰氨基酚
C. 阿司匹林
D. 吲哚美辛
E. 贝诺酯

正确答案：A。布洛芬

解析：本组题考查发热的药物治疗。非甾体抗炎药中镇痛作用较强，对胃肠刺激性最低的是布洛芬（A对）。布洛芬具有解热镇痛抗炎作用，其镇痛作用较强，比阿司匹林强16～32倍；抗炎作用较弱，退热作用与阿司匹林相似但较持久。其胃肠道的不良反应较轻，易于耐受，为此类药物中对胃肠刺激性最低的。对乙酰氨基酚（B错）解热作用强，镇痛作用较弱，但作用缓和而待久，对胃肠道刺激小，正常剂量下较为安全有效，是首选的退热药。阿司匹林（C错）为解热镇痛药，可抑制血小板聚集，有增加消化道出血的危险。贝诺酯（E错）为对乙酰氨基酚与阿司匹林的酯化物，通过抑制前列腺素的合成而产生镇痛、抗炎和解热作用。对胃肠道的刺激性小于阿司匹林。疗效与阿司匹林相似，作用时间较阿司匹林及对乙酰氨基酚长。